男，41岁。2周前搬重物时出现腰部疼痛，排便时加重，并向左下肢放射，逐渐出现左小腿皮肤感觉减退。查体：腰部活动受限，左侧直腿抬高40°出现左下肢放射性疼痛。腰椎X线片未见异常。最可能的诊断是
A. 腰椎间盘突出症
B. 腰椎肿瘤
C. 腰椎管狭窄症
D. 强直性脊柱炎
E. 腰扭伤

正确答案：A。腰椎间盘突出症

解析：中年男性患者，搬重物时出现腰部疼痛，排便时加重、并向左下肢放射（腰椎间盘突出症典型表现），查体腰部活动受限、左侧支腿抬高40°出现左下肢放射性疼痛（直腿抬高试验阳性），结合患者的病史、症状和体征，该患者最可能的诊断是腰椎间盘突出症（A对）。腰椎肿瘤（P734）（B错）腰痛多呈进行性加重，平卧不能减轻，X线平片可见骨破坏。腰椎管狭窄症（P734）（C错）多以下腰痛、马尾神经或腰神经受压症状为主要表现，以神经源性间歇性跛行为主要特点。。强直性脊柱炎（P765）（D错）主要累及骶髂关节，表现为下腰疼，且有晨僵和运动后缓解的特点。腰扭伤（E错）后立即出现腰部疼痛，呈持续性剧痛，一般无神经受累表现（即下肢放射性疼痛及感觉障碍）。